女，55岁。左乳房包块半年。乳房无不适，有时感左肩背部隐痛。查体：双肺呼吸音清，未闻及干湿性啰音，心律齐，腹软，无压痛。左乳房外上象限可触及3cm×2cm包块，质硬，不光滑，活动，无压痛。左腋窝触及3枚肿大淋巴结。乳腺钼靶摄片：左乳房2.5cm×2.0cm高密度影，周边有毛刺，中央有细沙样钙化点。【假设信息】患者术后2年出现腰背部疼痛，逐渐加重，为明确诊断首选的主要检查是
A. 血CEA
B. 血CA153
C. 免疫指标检测
D. 同位素骨扫描
E. PET-CT

正确答案：D。同位素骨扫描

解析：乳腺癌易经椎旁静脉系统转移至椎体，因此乳腺癌患者术后3年诉腰背部疼痛，考虑乳腺癌椎体转移。为明确诊断首选的主要检查是同位素骨扫描（D对），其敏感性较高，不仅可以早期发现骨转移病灶，还对恶性肿瘤患者的临床分期、选择合适的治疗计划、判定疗效等方面具有重要价值。血CEA（A错）即癌胚抗原（P391），主要用于预测直肠癌的预后和监测复发。血CA15-3（B错）即癌胚抗原153主要用于辅助诊断乳腺癌及预后监测。免疫指标检测（C错）主要用于诊断自身免疫性疾病。PET-CT（E错），即正电子发射计算机断层-CT与同位素骨扫描相比，具有半衰期短、骨骼系统辐射剂量小、图像分辨率高、对肿瘤检测灵敏度和特异性高等优势，但价格过于昂贵，因此一般不作首选。